女性，35岁，脾切除小肠切除吻合术后第5天，已排气，头痛恶心腹胀，随后出现寒颤，四肢发绀，体温39.6℃，脉搏108次/分，血压135/85mmHg，近24小时尿量650ml，轻度腹胀，腹软，全腹轻压痛，无反跳痛及肌紧张，肠鸣音3次/分。最可能的原因为
A. 小肠吻合口瘘
B. 手术后创面出血
C. 急性肾功能衰竭
D. 革兰染色阴性杆菌感染
E. 高位肠梗阻

正确答案：D。革兰染色阴性杆菌感染

解析：本例患者脾切除、肠切除术后5天，出现头痛、恶心、寒颤、高热（39.1～41℃即为高热），四肢发绀等症状，其最可能的诊断为革兰染色阴性杆菌感染（D对）。小肠吻合口瘘（A错）呈腹腔感染、腹膜炎、肠麻痹表现，该患者仅有轻度腹胀，腹软，无压痛、反跳痛、肌紧张，肠鸣音正常，不支持吻合口瘘的诊断。手术后创面出血（B错）一般出现在手术后24小时内，常表现为心搏过速、血压下降、尿排出量减少（尿量＜400ml/24h或＜17ml/h为少尿）、外周血管收缩等休克表现，若出血持续，腹围可能增加。急性肾功能衰竭（C错）除少尿外可出现多系统的不良症状，如恶心、呕吐、腹胀等消化系统症状，呼吸困难、咳嗽等呼吸系统症状，心力衰竭、电解质紊乱等循环系统症状，躁动、昏迷等神经系统症状。患者尿量正常，全身症状较轻，不支持急性肾功能衰竭的诊断。高位肠梗阻（E错）常表现为呕吐、腹痛、腹胀、排气排便停止。